中药品种申请二级保护的条件是
A. 对特定疾病有显著疗效的
B. 对一般疾病有明显作用的
C. 对特定疾病有特殊疗效的
D. 用于预防特殊疾病的
E. 用于治疗特殊疾病的

正确答案：A。对特定疾病有显著疗效的

解析：本题考查申请中药二级保护品种应具备的条件。申请中药二级保护品种应具备的条件：符合下列条件之一的中药品种，可以申请二级保护。①符合上述一级保护的品种或者已经解除一级保护的品种；②对特定疾病有显著疗效的（A对）；③从天然药物中提取的有效物质及特殊制剂。申请中药一级保护品种应具备的条件：符合下列条件之一的中药品种，可以申请一级保护。①对特定疾病有特殊疗效的（C错）；②相当于国家一级保护野生药材物种的人工制成品；③用于预防和治疗特殊疾病的（DE错）。